关于成熟卵泡，下列哪项是错误的
A. 排卵前卵泡即成熟卵泡
B. 卵泡液急剧增多
C. 体积显著增大
D. 卵泡期，需7～14日
E. 为卵泡发育的最后阶段

正确答案：D。卵泡期，需7～14日

解析：排卵前卵泡即成熟卵泡，也称为格拉夫卵泡，为卵泡发育的最后阶段，卵泡液急骤增加，卵泡腔增大，卵泡体积显著增大，直径达18～23mm，卵泡向卵巢表面突出。自月经第1日至卵泡发育成熟，称为卵泡期，需10～14日。掌握“女性生殖系统生理”知识点。